新增药物最多的古本草著作是
A. 《本草纲目》
B. 《新修本草》
C. 《中华本草》
D. 《本草纲目拾遗》
E. 《经史证类备急本草》

正确答案：D。《本草纲目拾遗》

解析：本题考查的是《本草纲目拾遗》。新增药物最多的古本草著作是《本草纲目拾遗》（D对）。《本草纲目拾遗》：简称《纲目拾遗》，为清代本草代表作。作者赵学敏，定稿于1803年（清嘉庆八年）。全书共10卷，载药921种，其中新增716种，创古本草增收新药之冠，极大地丰富了本草学。《本草纲目》（A错）：简称《纲目》，为明代本草代表作。作者李时珍，在公元1578年（明万历六年）完成这一巨著。全书共52卷，约200万字，载药1892种，绘药图1100余幅，附方11000余首。《新修本草》（B错）：又称《唐本草》，为隋唐时期唐代的本草代表作。书成于公元659年（唐显庆四年），共54卷，载药850种。是我国历史上第一本官修药典性本草，并被今人誉为世界上第一部药典。《中华本草》（C错）：为当代本草代表作。该书是由国家中医药管理局主持，南京中医药大学总编审。全书共34卷。前30卷为中药，共收载药物8980味，备考药物571种，插图8534幅，引用古今文献约1万余种，计约2800万字。《经史证类备急本草》（E错）：简称《证类本草》，为宋金元时期宋代的本草代表作。作者唐慎微，书稿定稿于1108年（宋大观二年）以前。全书共30卷，载药1746种，附方3000余首。